减毒活疫苗说明书中应标注的字样是
A. “在药师指导下购买和使用”
B. 黑体字警示语
C. “免费”
D. “不推荐在该疾病流行季节使用”

正确答案：D。“不推荐在该疾病流行季节使用”

解析：本题考查预防用生物制品列出使用的各种注意事项。减毒活疫苗说明书中应标注的字样是“不推荐在该疾病流行季节使用”（D对）。预防用生物制品列出使用的各种注意事项。以特殊接种途径进行免疫的制品，应明确接种途径，如注明“严禁皮下或肌内注射”。使用前检查包装容器、标签、外观、有效期是否符合要求。还包括疫苗包装容器开启时，对制品使用的要求（如需振摇），冻干制品的重溶时间等。疫苗开启后应在规定的时间内使用，以及由于接种该制品而出现的紧急情况的应急处理办法等。减毒活疫苗还需在该项下注明：本品为减毒活疫苗，不推荐在该疾病流行季节使用。处方药必须标注：“请仔细阅读说明书并在医师指导下使用”（A错），并印制在说明书标题下方。“警示语”是指对药品严重不良反应及其潜在的安全性问题的警告，还可以包括药品禁忌、注意事项及剂量过量等需提示用药人群特别注意的事项。有该方面内容的，应当在说明书标题下以醒目的黑体字注明（B错）。无该方面内容的，不列该项。含有化学药品（维生素类除外）的中药复方制剂，应注明本品含××（化学药品通用名称）。疫苗的包装标识：《条例》第13条规定，疫苗生产企业应当在其供应的纳入国家免疫规划疫苗的最小外包装的显著位置，标明“免费”字样（C错）以及国务院卫生主管部门规定的“免疫规划”专用标识。具体管理办法由国务院药品监督管理部门会同国务院卫生主管部门制定。